室间隔缺损常见于
A. 卵圆窝
B. 室间隔肌部
C. 室间隔膜部
D. 室上嵴
E. Koch三角

正确答案：C。室间隔膜部

解析：室间隔膜部（C对）下方是肌性室间隔的嵴，前方为漏斗部肌肉，为室间隔缺损的常见部位。